最常见的引起龋齿的病菌是
A. 变形链球菌和乳酸杆菌
B. 变形链球菌
C. 乳酸杆菌
D. G⁺杆菌
E. 溶血性链球菌

正确答案：A。变形链球菌和乳酸杆菌

解析：本题考查龋齿的常见病菌。引起龋齿的病菌主要的是某些变形链球菌和乳酸杆菌（A对BCDE错），这些细菌与唾液中的粘蛋白和食物残屑混合在一起，牢固地粘附在牙齿表面和窝沟中。